下列有关现代流行病学叙述正确的是
A. 流行病学的研究范畴是疾病
B. 流行病学研究的角度是个人或人群
C. 流行病学从疾病或健康事件的分布出发
D. 流行病学用观察的研究方法揭示健康事件的人群特征
E. 流行病学是一门控制传染病在人群中流行的科学

正确答案：C。流行病学从疾病或健康事件的分布出发